休克晚期微循环灌流的特点是
A. 不灌不流
B. 多灌少流
C. 少灌少流
D. 多灌多流
E. 少灌多流

正确答案：A。不灌不流

解析：休克晚期即微循环衰竭期，此期微血管发生麻痹性扩张，毛细血管大量开放，微循环中可有微血栓形成，血流停止，出现不灌不流（A对BCDE错）状态，组织几乎完全不能进行物质交换，得不到氧气和营养物质供应，甚至可出现毛细血管无复流现象。